肠结核溃疡的肉眼形态是
A. 椭圆形，溃疡的长轴与肠的长轴平行
B. 口小底大烧瓶状
C. 不规则地图状
D. 呈带状，其长径与肠长轴垂直
E. 火山喷口状

正确答案：D。呈带状，其长径与肠长轴垂直

解析：肠结核溃疡的肉眼形态是：肠壁淋巴管环肠管行走，病变沿淋巴管扩散，溃疡多呈带状，其长径与肠腔长轴垂直（D对）。溃疡呈椭圆形，其长轴与肠的长轴平行（A错）是肠伤寒（P359）病变的特点。溃疡呈口小底大烧瓶状（B错）是肠阿米巴病（P369）的病变特点。溃疡呈不规则地图状（C错）是细菌性痢疾（P360）的病变特点。溃疡呈火山喷口状（E错）是癌性溃疡（P210）的病变特点。